在苯二氮䓬结构的1，2位开合三氮唑结构，其脂溶性增加，易通过血脑屏障，产生较强的镇静催眠作用的药物是
A. 地西泮
B. 奥沙西泮
C. 氟西泮
D. 阿普唑仑
E. 氟地西泮

正确答案：D。阿普唑仑

解析：本题考查苯二氮䓬类药物。艾司唑仑、阿普唑仑（D对）和三唑仑在1，4-苯二氮䓬的1，2位并上三唑环，不仅可使代谢稳定性增加，而且提高了与受体的亲和力，活性显著增加。地西泮（A错）、奥沙西泮（B错）、氟西泮（C错）、氟地西泮（E错）均不含有三氮唑结构。